显微鉴别可见无色不规则颗粒状团块或末端钝圆分枝状结构的药材是
A. 灵芝
B. 冬虫夏草
C. 松萝
D. 茯苓
E. 猪苓

正确答案：D。茯苓

解析：本题考查猪苓的显微鉴别。显微鉴别可见无色不规则颗粒状团块或末端钝圆分枝状结构的药材是茯苓（D对）。茯苓【显微鉴别】粉末：灰白色。①用水或稀甘油装片，可见无色不规则颗粒状团块或末端钝圆的分枝状团块；用水合氯醛液或5%氢氧化钾液装片，则团块溶化露出菌丝。②菌丝细长，稍弯曲，有分枝，无色或带棕色（外层菌丝），直径3～8㎛，稀至16㎛，横壁偶可察见。灵芝（A错）【显微鉴别】粉末：浅棕色、棕褐色至紫褐色。菌丝散在或黏结成团，无色或淡棕色，细长，稍弯曲，有分枝，直径2.5～6.5㎛。孢子褐色，卵形，顶端平截，外壁无色，内壁有疣状突起，长8～12㎛，宽5～8㎛。冬虫夏草（B错）【显微鉴别】子座头部横切面：①子座周围1列子囊壳，子囊壳卵形至椭圆形，下半部埋于凹陷的子座内。②子囊壳内有多数线形子囊，每个子囊内又有2～8个线形的子囊孢子。③子座中央充满菌丝，其间有裂隙。④具不育顶端（子座先端无子囊壳部分）。松萝（C错）【性状鉴别】松萝地衣体长10～40cm，呈二叉状分枝，基部直径0.8～1.5mm。表面灰绿色或黄绿色，粗枝表面有明显的环状裂纹。质柔韧，略有弹性，不易折断，断面可见中央有线状强韧的中轴。气微，味酸。猪苓（E对）【显微鉴别】粉末：菌丝黏结成团（菌丝团），大多无色。散在的菌丝细长、弯曲，直径2～10㎛，有的可见横隔，有分枝或呈结节状膨大。草酸钙结晶呈正八面体形、规则的双锥八面体形或不规则多面体，直径3～60㎛，长至68㎛。